属于流行病学描述性研究方法范畴的是
A. 横断面研究
B. 巢式病例对照研究
C. 队列研究
D. 现场试验
E. 单纯病例研究

正确答案：A。横断面研究